药品批准文号标号前注Z者为
A. 辅料
B. 西药
C. 生物制品
D. 中药
E. 进口原料药生产的制剂

正确答案：D。中药

解析：本题考查药品批准文号的格式。药品批准文号标号前注Z者为中药（D对）。药品批准文号的格式为：国药准字H（Z、S、J）+4位年号+4位顺序号，其中H代表化学药品，Z代表中药，S代表生物制品（C错），J代表进口药品分包装（E错）。